常引起生殖器疱疹的病原体是
A. HSV-1
B. HSV-2
C. VZV
D. CMV
E. EBV

正确答案：B。HSV-2